女，28岁，间断发热、刺激性咳嗽3周。查体：T37.5℃，右上肺可闻及哮鸣音。血常规正常，ESR45mm/h。自服“头孢菌素”及“阿奇霉素”治疗无效。胸部X线片示上肺纹理增粗、紊乱。痰涂片抗酸染色可疑阳性，对明确诊断最有意义的处理措施是
A. 支气管镜检查
B. 诊断性抗结核治疗
C. 痰分枝杆菌培养
D. 胸部CT检查
E. 肺功能检查

正确答案：C。痰分枝杆菌培养

解析：患者青年女性，间断发热、刺激性咳嗽3周。查体：T37.5℃（低热），右上肺可闻及哮鸣音。ESR45mm/h（0～20mm/h（正常女性））。自服“头孢菌素”及“阿奇霉素”治疗无效，说明并不是常规细菌性感染。胸部X线片示上肺纹理增粗、紊乱。痰涂片抗酸染色可疑阳性（结核分枝杆菌抗酸染色阳性）。根据病史、临床表现、辅助检查可诊断为肺结核。痰结核分枝杆菌检查是确诊肺结核病的主要方法（C对）（P65）